牙本质涎蛋白位于
A. 管间牙本质
B. 管周牙本质
C. 前期牙本质
D. 修复牙本质
E. 小球间牙本质

正确答案：B。管周牙本质

解析：牙本质涎蛋白和牙本质基质蛋白-1主要位于管周牙本质，可以抑制管周牙本质的沉积，防止牙本质小管的闭合。牙本质中的生长因子有转化生长因子β、胰岛素样生长因子和成纤维细胞生长因子。这些生长因子可能在诱导新的成牙本质细胞形成、创伤修复中起重要作用。掌握“牙本质”知识点。